第二信使
A. DG
B. Na⁺-K⁺-ATP酶
C. 线粒体内膜嵴
D. FFO复合体
E. GLUT4

正确答案：A。DG